阳经郄穴主要用于治疗
A. 脏病
B. 经脉病
C. 腑病
D. 痛症
E. 血证

正确答案：D。痛症

解析：郄穴是经脉之气深聚部位的腧穴，在临床上郄穴多用于治疗各经的急性病症，阴经郄穴治急性血症，阳经郄穴治急性痛症（D对）。